患者，男，21岁。呼吸困难，咳嗽，汗出1小时而就诊。查体：端坐呼吸，呼吸急促，口唇微绀，心率114次/分，律不齐，双肺满布哮鸣音。为迅速缓解症状，应立即釆取的最佳治法是
A. 口服氨茶碱
B. 肌注氨茶碱
C. 喷吸沙丁胺醇
D. 口服泼尼松
E. 口服阿托品

正确答案：C。喷吸沙丁胺醇

解析：缓解哮喘发作的药物主要作用为舒张支气管。首选吸入法，因药物吸入气道直接作用于呼吸道，局部浓度高且作用迅速，所用剂量较小，全身性不良反应少，临床常用沙丁胺醇（C对）。口服（A错）或肌注氨茶碱（B错）可缓解支气管痉挛，但起效慢，不作为快速缓解症状的最佳治法。口服泼尼松（D错）用于重度至危重度的治疗。口服阿托品（E错）不可快速缓解症状。